男，56岁。2年来间断出现活动时胸闷，休息时可缓解，近4个月无胸闷发作。查体：BP130/85mmHg，心率72次/分，心脏各瓣膜区未闻及杂音。最有助于明确诊断的检查是
A. 放射性核素静态心肌造影
B. 动态心电图
C. 超声心动图
D. 心电图运动负荷试验
E. 胸部X线片

正确答案：D。心电图运动负荷试验

解析：患者中老年男性，有活动后胸闷、休息缓解的表现，疑诊为冠心病心绞痛型。心电图运动负荷试验（D对）是目前诊断冠心病最常用的一种辅助手段，通过运动增加心脏负荷而诱发心肌缺血，从而出现缺血性心电图改变的试验方法，常用活动平板运动试验。其优点是运动中即可观察心电图和血压的变化，运动量可按预计目标逐步增加。放射性核素静态心肌造影（A错）可定量分析心肌灌注和心肌存活，但稳定型心绞痛尚未发展到心肌坏死。动态心电图（B错）用于检查非持续性心律失常，尤其是一过性心律失常及短暂的心肌缺血发作，测量时间内患者不一定会有心绞痛的表现，不能准确捕捉心绞痛时的异常心电图。超声心电图（C错）是评价心脏收缩、舒张功能以及左心室充盈血流动力学的主要定量手段，但多数稳定型心绞痛患者静息时超声心动图检查无异常。胸部X线片（E错）能显示出心脏大血管的大小、形态、位置和轮廓，不能评价心功能，对稳定型心绞痛并无特异的诊断意义。